治疗吐血胃热壅盛证，应首选
A. 玉女煎
B. 龙胆泻肝汤
C. 加味清胃散合泻心汤
D. 地榆散合槐角丸
E. 泻心汤合十灰散

正确答案：E。泻心汤合十灰散

解析：题中选项均为血证的选方。鼻衄胃热炽盛证治宜清胃泻火，凉血止血，方选玉女煎（A错）。吐血肝火犯胃证治宜泻肝清胃，凉血止血，方选龙胆泻肝汤（B错）。齿衄胃火炽盛证治宜清胃泻火，凉血止血，方选加味清胃散合泻心汤（C错）。便血肠道湿热证治宜清化湿热，凉血止血，方选地榆散合槐角丸（D错）。泻心汤功能清胃泻火，十灰散能够清热凉血，收涩止血，两方合用既能清胃热，又能止血，最宜治疗吐血胃热壅盛证（E对）。